医疗机构麻醉药品专用账册的保存期限自药品有效期期满之日起不小于
A. 1年
B. 2年
C. 3年
D. 4年
E. 5年

正确答案：E。5年

解析：本题考查麻醉药品和第一类精神药品的储存。医疗机构麻醉药品专用账册的保存期限自药品有效期期满之日起不小于5年（E对）。定点生产企业、全国性批发企业和区域性批发企业、麻醉药品和第一类精神药品的使用单位，应当配备专人负责管理工作，并建立储存麻醉药品和第一类精神药品的专用账册。专用账册的保存期限应当自药品有效期期满之日起不少于5年。